下列药材宜用姜炙的是
A. 黄连
B. 杜仲
C. 甘遂
D. 厚朴
E. 淫羊藿

正确答案：A、D。黄连；厚朴

解析：本题考查的是黄连与厚朴的炮制方法。下列药材宜用姜炙的是黄连（A对）与厚朴（D对）。黄连：【炮制方法】处方用名有黄连、川连、酒黄连、姜黄连、吴萸连、萸黄连。厚朴：【炮制方法】处方用名有厚朴、川厚朴、姜厚朴。杜仲（B错）：【炮制方法】处方用名有杜仲、川杜仲、炒杜仲、盐杜仲。甘遂（C错）：【炮制方法】处方用名有甘遂、炙甘遂、醋甘遂。淫羊藿（E错）：【炮制方法】处方用名有淫羊藿、羊藿、仙灵脾、炙淫羊藿、炙羊藿。